患者，女，28岁，因“多汗、心慌、消瘦、易怒半月余”就诊，实验室检查显示FT₄和FT₃均升高，TSH降低，甲状腺Ⅱ度肿大，心率92次/分，诊断为“甲状腺功能亢进症”（简称“甲亢”）。给予甲巯咪唑片10mg，一日3次，盐酸普萘洛尔片10mg，一日3次。患者1月后复查，FT₃和FT₄恢复正常，但出现膝关节疼痛。若患者处于哺乳期，但甲亢未治愈，而继续治疗。关于其用药的说法，正确的是
A. 哺乳期妇女可选用丙硫氧嘧啶
B. 哺乳期妇女禁用甲巯咪唑
C. 哺乳期妇女禁用普萘洛尔
D. 哺乳期妇女应停止甲亢的治疗
E. 甲巯咪唑不经乳汁分泌，哺乳期妇女可以使用

正确答案：A。哺乳期妇女可选用丙硫氧嘧啶

解析：本题考查甲巯咪唑片用药注意事项。关于其用药的说法，正确的是哺乳期妇女可选用丙硫氧嘧啶（A对）。丙硫氧嘧啶可由乳汁分泌，母乳服用较大剂量抗甲状腺药时，可能引起婴儿甲状腺功能减退，应严密监测受乳儿的生长发育和甲状腺功能，可停止哺乳或使用最低有效剂量的药物（B错），其中丙硫氧嘧啶较卡比马唑或甲巯咪唑更不易进入乳汁（E错），因此更适用。普萘洛尔可少量由乳汁分泌，哺乳期妇女慎用（C错）。